属于智力测验的是
A. MMPI
B. 16PF
C. EPQ
D. TAT
E. WPPSI

正确答案：E。WPPSI

解析：本题考查智力测验。属于智力测验的是WPPSI（E对）。1.韦氏智力量表由美国心理学家韦克斯勒所编制，是继比奈―西蒙智力量表之后为国际通用的另一套智力量表。韦氏智力测验共有三套：分成人（WAIS）、儿童（WISC）、幼儿（WPPSI）。其中，韦氏成人智力量表适用于16岁以上的成人；韦氏儿童智力量表适用于6—16岁儿童；韦氏学前儿童智力量表适用于4—6岁儿童。2.明尼苏达多项人格测验（简称MMPI）（A错），主要用于检测和筛查心理健康、精神疾病（疑病、癔症、抑郁、偏执、精神病态、精分、躁狂、异性化、内向和精神衰弱）等。3.16PF（B错）一般指卡特尔16种人格因素问卷，卡特尔在其人格的解释性理论构想的基础上编制了16种人格因素问卷，从16个方面描述个体的人格特征。这16个因素或分量表的名称和符号分别是：乐群性（A）、聪慧性（B）、稳定性（C）、恃强性（E）、兴奋性（F）、有恒性（G）、敢为性（H）、敏感性（I）、怀疑性（L）、幻想性（M）、世故性（N）、忧虑性（O）、实验性（Q1）、独立性（Q2）、自律性（Q3）、紧张性（Q4）。4.艾森克人格问卷简称EPQ（C错），包括四个分量表：内外倾向量表（E），情绪性量表（N），心理变态量表（P，又称精神质）和效度量表（L）。艾森克人格问卷是目前医学、司法、教育和心理咨询等领域应用最为广泛的问卷之一。5.TAT（D错）是Tapas Acupressure Technique的简称，是最简单的能量疗愈法。